下列各项，最简便且较准确测定胎儿安危的方法是
A. 胎儿电子监护
B. 尿雌三醇测定
C. 胎动计数
D. 羊膜镜检查
E. 缩宫素激惹试验

正确答案：C。胎动计数

解析：计数胎动是自我监护胎儿情况变化的一种简便、安全而又可靠的手段。胎动正常是胎儿宫内良好的一种表现，当胎儿宫内缺氧时，往往首先胎动减少，继而消失，胎心音24小时也会消失，而胎动过频也是胎儿宫内缺氧的表现，常常是胎儿早期缺氧的症状，因此，每日监测胎动可预知胎儿安危（C对）。胎儿电子监护可反应胎心，胎动，子宫收缩之间的关系，但不符合题意（A错）。尿雌三醇测定提示胎盘功能（B错）。羊膜镜检查是应用羊膜观察妊娠期或分娩期的羊水情况，判断胎儿安危的检查，不合题意（D错）。缩宫素激惹试验可记录胎心变化，测定胎儿储备能力，不合题意（E错）。